男，18岁。反复左侧腰部胀痛3年余。B超见左肾重度积水，左输尿管显示不清。总肾功能正常，尿常规：RBC（-），WBC5～10/HP。IVU检查示左肾显影不清晰，右肾正常。有效的治疗方法是
A. 抗感染治疗
B. 肾盂输尿管成形
C. 继续观察
D. 放置输尿管支架引流
E. 左肾造瘘

正确答案：E。左肾造瘘

解析：青年男性患者，左侧腰部胀痛，B超见左肾重度积水，左输尿管显示不清，IVU示左肾显影不清晰，右肾正常，结合患者病史、临床表现和相关检查，应考虑左肾结核。该患者右肾功能正常，应首选患肾（左肾）切除术，但答案选项中并未给出，因此可先行左肾造瘘（E对），引流患侧积水，然后根据肾功能恢复情况再考虑是否行肾切除术。抗感染治疗（A错）仅适用于早期肾结核，该患者IVU示左肾不显影，提示左肾功能丧失，故该治疗价值不大。肾盂输尿管成形术（B错）、放置输尿管支架引流（D错）常用于输尿管结核合并狭窄的患者，该患者未提示有输尿管狭窄，故不适用。该患者已有左肾重度积水，继续观察（C错）显然不妥。